肾盂癌患者有血尿，双侧肾功能正常，首选的治疗方法是
A. 肾切除
B. 肾盂肿瘤切除
C. 化疗
D. 患肾及输尿管全切除
E. 继续观察

正确答案：D。患肾及输尿管全切除

解析：肾盂癌患者，双侧肾功能正常，故此时可行根治性切除术，首选的治疗方法是患肾及输尿管全切除（D对），包括输尿管开口部位的膀胱壁。肾切除（A错）主要用于肾癌的治疗。肾盂肿瘤切除（B错）主要用于孤立肾或对侧肾功能已受损，肿瘤细胞分化良好、无浸润的带蒂乳头状肿瘤。化疗（C错）多用于晚期有转移的患者。患者确诊肾盂癌有血尿症状，继续观察（E错）显然不对。